收益是评价筛检效果的主要指标之一，以下哪种方法不能改善筛检试验的收益
A. 采用全人群普查的方法
B. 选择患病率高的人群开展筛检试验
C. 采用联合试验
D. 选择高危人群开展筛检试验
E. 选择灵敏度高的筛检试验方法

正确答案：A。采用全人群普查的方法